阴户是
A. 分泌带下的通道
B. 防御外邪入侵的第一道门户
C. 排出月经的通道
D. 阴阳交合的器官
E. 娩出胎儿的路径

正确答案：B。防御外邪入侵的第一道门户

解析：阴户指女性外阴，包括阴道前庭及其两侧的大阴唇和小阴唇、前面的阴蒂和后面的阴唇系带、会阴。阴户是抵御外邪的第一道关口，具有保护女性生殖脏器的作用（B对）。分泌带下的通道、排出月经的通道、阴阳交合的器官、娩出胎儿的路径皆是对阴道作用的描述（ACDE错）。